某女，51岁。因反复胸闷、胸痛2年余就诊，2年前因琐事与人争吵后，出现左前胸胀痛，伴胸胁胀痛，心悸，休息后缓解，未予重视。此后，胸闷胸痛反复发作，多于情绪波动后症状加重，严重时可放射至左后肩。患者情志抑郁，善太息，纳差，寐欠安，小便黄，大便失调，唇舌紫暗，脉弦涩。既往有慢性乙型肝炎10余年，对酒精过敏。临床给予血脂、肝肾功能、心肌酶谱、心电图及平板运动试验等检查。西医诊断为冠心病心绞痛；中医诊断为胸痹，辨证为气滞血瘀证。处方如下：中药汤剂：柴胡10g，赤芍10g，炒枳壳10g，生甘草10g，桃仁10g，红花9g，生地黄15g，川牛膝10g，当归9g，党参15g，炙乳没（各）6g，桔梗9g，川楝子15g，延胡索粉（分冲）3g。共5剂，水煎服，每日1剂，早、晚分服。中成药：血府逐瘀口服液10ml×12支，每次10ml，3次/日；复方丹参滴丸25mg×100丸，10丸/次，3次/日；速效救心丸40mg×100丸，舌下含服10粒，必要时服用；茵栀黄口服液10ml×10支，每次10ml，3次/日。该患者在服用中药治疗的第2天，胃脘部不适加重，并伴恶心呕吐症状，执业药师对此种现象的分析，最恰当的是
A. 所服中药汤剂中含有红花，可能存在消化道刺激
B. 所服中成药中含有丹参，可能存在消化道刺激
C. 所服血府逐瘀口服液中含有酒精，可能存在消化道刺激
D. 所服中药剂中含有炙乳没，可能存在消化道刺激
E. 所服中药延胡索应该煮后再入药，可避免消化道刺激

正确答案：D。所服中药剂中含有炙乳没，可能存在消化道刺激

解析：本题考查的是乳没的使用注意。患者在服用中药治疗的第2天，胃脘部不适加重，并伴恶心呕吐症状，执业药师对此种现象的分析，最恰当的是所服中药剂中含有炙乳没，可能存在消化道刺激（D对）。炙乳没是指乳香和没药。乳香【使用注意】本品味苦活血，入煎剂常致汤液混浊，多服易致呕吐，故用量不宜过大，胃弱呕逆者慎服，孕妇及无血滞者不宜用。没药【使用注意】本品味苦活血，入煎剂常致汤液混浊，胃弱者多服易致呕吐，故用量不宜过大，胃弱呕逆者慎服，孕妇及无血滞者不宜用，疮疡溃后勿服，脓多勿敷。